痰浊阻肺常见的症状有
A. 气喘胸满，苔白腻
B. 咳喘，咯吐脓血臭痰
C. 咳嗽痰多，色白易咯
D. 痰少而黏，缠喉难出
E. 痰多黄稠，不易咯出

正确答案：A、C。气喘胸满，苔白腻；咳嗽痰多，色白易咯

解析：本题考查的是痰浊阻肺证的临床表现及辨证要点。痰浊阻肺常见的症状有气喘胸满，苔白腻（A对）、咳嗽痰多，色白易咯（C对）。痰浊阻肺证的临床表现及辨证要点，痰浊阻肺证的临床表现，常见咳嗽，痰量多，色白而黏，容易咳出，或见气喘、胸满、呕恶等症，舌苔白腻，脉象多滑。一般以咳嗽痰多质黏、色白易咳为辨证要点。风热犯肺证的临床表现及辨证要点，风热犯肺证的临床表现，常见咳嗽，咳黄稠痰，不易咳出（E错），甚则咳吐脓血臭痰（B错），一般还伴咽喉疼痛、鼻流浊涕、口干欲饮等，舌尖红，脉浮数。病重者可见气喘鼻扇、烦躁不安。一般以咳嗽与风热表证共见为辨证要点。燥热犯肺证的临床表现及辨证要点，燥热犯肺证的临床表现，常见干咳无痰，或痰少而黏，缠喉难出（D错），鼻燥咽干，舌尖红，苔薄白少津，脉浮细而数。并常伴有胸痛或发热头痛、身酸楚等症状。一般以肺系症状表现干燥少津为辨证要点。